女，60岁。反复咳嗽咳痰25年，心悸气促下肢间歇水肿3年，病情加重伴畏寒发热1周入院。体检：T38度，呼吸急促，口唇发绀，双肺叩诊过清音，中下肺闻及湿啰音，心率110次/分，心律齐，无杂音，双下肢重度水肿。假设病情仍继续恶化，出现昏睡或昏迷，血气分析示：PaO₂6.7kPa（50mmHg），PaCO₂10.7kPa（50mmHg），此时首先考虑的合并征为
A. 感染中毒性脑病
B. 肺性脑病
C. ARDS
D. 脑出血
E. 脑梗塞

正确答案：B。肺性脑病

解析：患者反复咳嗽咳痰25年，双肺叩诊过清音（为慢阻肺的典型表现），考虑诊断为慢阻肺（COPD）。口唇发绀，双下肢重度水肿，考虑诊断为由COPD引起的慢性肺心病，患者血气分析示：PaO₂ 7kPa（50mmHg），PaCO₂ 7kPa（50mmHg），说明合并Ⅱ型呼衰（PaO₂＜60mmHg，PaCO₂＞50mmHg，即高碳酸性呼吸衰竭），出现昏睡或昏迷等神经精神障碍的症状，说明已合并肺性脑病（B对）。感染中毒性脑病（A错）多见于儿童，表现为高热、严重头痛、呕吐、烦躁不安和谵妄乃至昏迷。脑出血（D错）发生的原因主要与脑血管的病变有关，即与高血脂、糖尿病、高血压、血管的老化、吸烟等密切相关，通常在活动和情绪激动时发病，出血前多无预兆，半数患者出现头痛并很剧烈，常见呕吐，出血后血压明显升高，临床症状常在数分钟至数小时达到高峰。脑梗塞（E错）的临床表现复杂，多与栓塞的部位有关，主要有一些躯体症状如肢体偏瘫或轻度偏瘫、偏身感觉减退、步态不稳、肢体无力、大小便失禁等。合并ARDS（P131）（C错）最早出现的症状是呼吸加快，并呈进行性加重的呼吸困难，早期不会出现昏迷。